某水产养殖水体在施撒有机肥后湖面不断冒出气泡，短期内突然有大量的鱼类死亡，最常见的原因是
A. 水的pH值异常
B. 水中溶解氧含量过低
C. 水中有毒物存在
D. 水中致病微生物存在
E. 鱼类的营养物质严重缺乏

正确答案：C。水中有毒物存在

解析：本题考查水体中鱼类死亡最常见的原因。当有机肥施撒后，水体中毒物的含量显著增加，这些毒物会对鱼类的生活环境产生毒性，从而导致鱼类死亡。因此，水中有毒物存在（C对ABDE错）最有可能导致水体中的鱼类突然大量死亡。